高血压患者适宜选择的食物是
A. 动物内脏
B. 巧克力
C. 糖果
D. 油酥点心
E. 牛奶

正确答案：E。牛奶

解析：本题考查高血压患者适宜选择的食物。高血压患者适宜选择富含钙的食品，如牛奶（E对）。不宜选择高胆固醇食物，如动物内脏（A错）；高能量密度的食物，如巧克力（B错）、糖果（C错）、油酥点心（D错）等。